对腮腺的描述，错误的是
A. 分浅深2部，浅部略呈三角形
B. 位于耳廓前下方和下颌后窝内
C. 腮腺管自浅部前缘上部发出
D. 开口于固有口腔
E. 无

正确答案：D。开口于固有口腔

解析：腮腺可分为浅、深2部，浅部略呈三角形(A对)，浅部前至咬肌后1/3浅面，即耳廓前下方，深部伸入下颌后窝内(B对)，腮腺管自浅部前缘发出，发出位置位于前缘的上部(C对)，开口于平对上颌第2磨牙牙冠对着的颊粘膜上的腮腺管乳头(D错，为本题正确答案)。